从脚间窝穿出的脑神经是
A. 滑车神经
B. 动眼神经
C. 三叉神经
D. 面神经
E. 展神经

正确答案：B。动眼神经

解析：从脚间窝穿出的脑神经是动眼神经（B对）。滑车神经（A错）从中脑下丘下方出脑。三叉神经（C错）从脑桥基底部与小脑中脚交界处出脑。面神经（D错）从脑桥延髓沟外侧部出脑。展神经（E错）从脑桥延髓沟中线两侧出脑。